依据《医疗机构制剂注册管理办法（试行）》，可以申报为医疗机构制剂的是
A. 市场已有供应的品种
B. 中药注射剂
C. 中药、化学药组成的复方制剂
D. 除变态反应原外的生物制品
E. 本单位临床需要的固定处方制剂

正确答案：E。本单位临床需要的固定处方制剂

解析：本题考查的是医疗机构制剂的定义。依据《医疗机构制剂注册管理办法（试行）》，可以申报为医疗机构制剂的是本单位临床需要的固定处方制剂（E对）。医疗机构制剂的定义：《医疗机构制剂注册管理办法（试行）》（局令第20号）第3条规定：医疗机构制剂，是指医疗机构根据本单位临床需要经批准而配制、自用的固定处方制剂。《药品管理法》规定，医疗机构配制制剂，应当经所在地省、自治区、直辖市人民政府药品监督管理部门批准，取得医疗机构制剂许可证。无医疗机构制剂许可证的，不得配制制剂。医疗机构配制的制剂，应当是本单位临床需要而市场上没有供应的品种，并应当经所在地省、自治区、直辖市人民政府药品监督管理部门批准；但是，法律对配制中药制剂另有规定的除外。